老年性阴道炎的治疗可在阴道内放置少量
A. 孕激素
B. 雌激素
C. 雄激素
D. 糖皮质激素
E. 促性腺激素

正确答案：B。雌激素

解析：老年性阴道炎也称萎缩性阴道炎，其病因是绝经后妇女卵巢功能衰退，雌激素水平降低，阴道壁萎缩，黏膜变薄，局部抵抗力降低，其他致病菌过度繁殖或容易入侵引起炎症。针对病因，可在阴道内放置少量雌激素（B对）治疗。